下列关于慢性颌骨骨髓炎的临床特点的叙述中，正确的是
A. 口腔内及颌面部皮肤形成多个瘘孔
B. 大量炎性肉芽组织增生
C. 触之易出血，长期排脓
D. 有时从瘘孔排出死骨片
E. 以上均正确

正确答案：E。以上均正确

解析：慢性颌骨骨髓炎的临床特点，主要是口腔内及颌面部皮肤形成多个瘘孔，大量炎性肉芽组织增生，触之易出血，长期排脓；有时从瘘孔排出死骨片。如有大块死骨或多数死骨形成，在下颌骨可发生病理性骨折，出现咬合错乱与面部畸形。如不进行及时有效的治疗，病情可延续很久而不愈，造成机体慢性消耗与中毒，消瘦、贫血等。从口腔黏膜破溃瘘孔排出的脓液，不断进入消化道，有时可引起明显的胃肠道症状。掌握“颌骨骨髓炎”知识点。